体积最大的舌乳头
A. 丝状乳头
B. 轮廓乳头
C. 舌扁桃体
D. 菌状乳头
E. 叶状乳头

正确答案：B。轮廓乳头

解析：轮廓乳头(B对)为体积最大的舌乳头。